下列不是脱疽病因的是
A. 吸烟
B. 寒冻
C. 免疫
D. 激素紊乱
E. 饮酒

正确答案：E。饮酒

解析：脱疽的发生在中医上讲与长期吸烟、饮食不节、环境、禀赋及外伤等因素有关。血栓闭塞性脉管炎属于中医“脱疽”的范畴，该病与吸烟（A错）、寒凉（B错）、免疫（C错）和激素（D错）有密切关系（E错，为本题正确答案）。